男性，42岁。3天来右上后磨牙痛重，冷热加剧，夜间痛而来就诊。近1年多来，右上磨牙进食时咬到某特定位置时出现撕裂样痛，冷热敏感，平时咬物不适。检查：16咬合面似有近远中方向越过边缘嵴的细裂纹，颊尖高陡，无龋洞，不松动，叩痛（+）。为明确诊断做的重要检查是
A. 染色检查
B. 温度试验
C. 咬合关系检查
D. 电活力测试
E. X线片检查

正确答案：B。温度试验

解析：本题考查牙隐裂。为明确诊断做的重要检查是温度检查（B对）。根据题干可知，患牙为牙隐裂引起的急性牙髓炎，急性牙髓炎有典型的温度刺激痛表现，因此为了明确诊断，应进行温度检查。